3岁女孩，智能落后，表情呆滞，眼距宽，眼裂小，鼻梁低，舌伸出口外，流涎，皮肤细嫩，肌张力低，通贯手。其特有体征不包括
A. 眼裂小，眼距宽
B. 张口伸舌，流涎多
C. 皮肤粗糙增厚
D. 常合并先天性畸形
E. 精神运动发育迟缓

正确答案：C。皮肤粗糙增厚

解析：学龄前儿童，智能落后（唐氏综合征最突出的临床表现），表情呆滞，眼距宽，眼裂小，鼻梁低，舌伸出口外，流涎（以上属于唐氏综合征的特殊面容），皮肤细嫩，肌张力低，通贯手（唐氏综合征特有的皮纹特征），根据患儿的临床症状，考虑该患儿最可能的诊断为唐氏综合征，其特有体征不包括皮肤粗糙增厚（C错，为本题正确答案），该病患儿皮肤及毛发正常。